患者，男，40岁。症见腹部胀满，有腹水，呼吸喘促，大小便不利。其治则是
A. 先治其标
B. 先治其本
C. 标本兼治
D. 因人制宜
E. 扶正祛邪

正确答案：A。先治其标

解析：根据急则治其标的治则，一般适用于病情严重，在疾病过程中又出现某些危急症状的情况，如病因明确的剧痛，频繁呕吐，二便不通，可分别采用缓急止痛，降逆止呕，通利二便等治标之法，缓解危机再图其本，若腹水严重，腹部胀满，呼吸急促，二便不利时，则为标急，此时应当先治标病之腹水，待腹水减退，病情稳定后，再治其肝病（A对）。缓则治本（B错）适用于慢性疾病或急性疾病的恢复期，如痨病肺肾阴虚之咳嗽。标本兼治（C错）适用于标病和本病错杂并重的疾病。因人制宜（D错）是根据病人的年龄、性别、体质等不同的特点，来制订适宜的治疗原则。扶正祛邪（E错）适用于正气不足，邪气盛实的疾病。